患者，女，20岁。喉结两侧弥漫性肿大，边界不清，皮色如常，无疼痛，诊为气瘿。治疗应首选
A. 海藻玉壶汤
B. 四海舒郁丸
C. 柴胡清肝汤
D. 逍遥蒌贝散
E. 十全流气饮

正确答案：B。四海舒郁丸

解析：题中患者诊断为气瘿，治宜理气舒郁，化痰消瘿，方用四海舒郁丸（B对）。海藻玉壶汤为痰结血瘀证之瘿病的代表方（A错）。柴胡清肝汤养血清火，疏肝散结，主血虚火动，肝气郁结致患鬓疽（C错）。逍遥蒌贝散疏肝理气，化痰散结，主治乳癖，瘰疬，乳癌初起（D错）。十全流气饮主治忧思抑郁致气瘿、肉瘤（E错）。